蛛网膜下腔出血的常见病
A. 糖尿病
B. 脑脂肪瘤
C. 动脉粥样硬化
D. 动脉瘤
E. 风湿性心脏瓣膜病

正确答案：D。动脉瘤

解析：本题考查自发性蛛网膜下腔出血。蛛网膜下腔出血的常见病是动脉瘤（D对）。颅内动脉瘤和脑（脊髓）血管畸形，占自发性蛛网膜下腔出血的70%，前者较后者多见，其他原因有动脉硬化、烟雾病、脑肿瘤卒中、血液病、动脉炎、脑炎、脑膜炎及抗凝治疗的并发症等。